下面对水溶性维生素特点描述不正确的是
A. 经血液吸收
B. 从尿中排泄
C. 缺乏症状出现较快
D. 多数能在体内大量储存
E. 几乎没有毒性

正确答案：D。多数能在体内大量储存